位于郊区的某一居民区，在其常年主导风向的上风侧建了一个垃圾焚烧厂。鉴于本地众多居民的投诉，因而对该厂进行环境流行病学调查。若要减弱该垃圾焚烧厂对该居民区的危害，可考虑增加烟囱高度，以增加污染物的扩散；污染物的排出高度增加一倍，则烟波着陆点的污染物浓度可降为原来的
A. 1/2
B. 2/3
C. 1/4
D. 1/6
E. 1/8

正确答案：C。1/4

解析：本题考查烟波着陆点的污染物浓度。一般认为，污染源下风侧的污染物最高浓度与烟波的有效排出高度的平方成反比，即有效排出高度每增加一倍，烟波着陆点处断面污染物的浓度可降至原来的1/4（C对ABDE错）。